审核医师处方、保证处方药调配质量是
A. 执业药师的责任
B. 执业药师的权力
C. 执业药师的义务
D. 执业药师的权利
E. 执业药师的执业行为规范

正确答案：A。执业药师的责任